医学科研中的人体实验必须坚持
A. 使受试者的疾病得到治疗
B. 使受试者获得经济利益
C. 必须使受试者知情同意
D. 要保证受试者的绝对安全
E. 要保证受试者无任何不适

正确答案：C。必须使受试者知情同意

解析：医学科研中的人体实验中知情同意权是受试者权益保障的基础（C对）。受试者参加试验的受益有可能包括缓解病症（A错）。对受试者参加试验的激励补偿应该是合理的补偿，要避免过度劝诱（B错）。试验风险分为设计性风险与技术性风险。设计性风险主要源于双盲法与安慰剂的使用。科学的试验设计是消除主观因素干扰、达到客观效应的需要，但同时也给受试者带来设计性风险；技术性风险包括身体的、心理的、社会的和经济的伤害，对技术性风险的评估可以在定性和定量两方面进行（DE错）。